患儿，男，2岁。发热，咳嗽5天，口渴，小便短赤，舌红苔黄。检查：听诊双下肺固定中细湿啰音音，血白细胞总数及中性粒细胞增高。治疗应首选
A. 红霉素加二陈汤
B. 红霉素加三拗汤
C. 青霉素加麻杏石甘汤
D. 病毒唑加二陈汤
E. 病毒唑加银翘散

正确答案：C。青霉素加麻杏石甘汤

解析：据本病例患儿发热、咳嗽，查体：双下肺固定中细湿啰音，故初步诊断为肺炎，化验血白细胞总数及中性粒细胞增高提示细菌性肺炎，治疗可选用青霉素、红霉素等。风热之邪外侵，邪热闭肺，肺气郁阻，失于宣肃，则发热，咳嗽；热灼津液，故口渴，小便短赤；舌红苔黄，为风热之象，故其证候为风热闭肺，治以辛凉宣肺，清肺止咳，方药为银翘散合麻杏石甘汤，故治疗应首选青霉素加麻杏石甘汤（C对）。二陈汤功用为燥湿化痰，理气和中，适用于湿痰证（AD错）。三拗汤（B错）功用为宣肺解表，适用于风寒闭肺证。病毒唑属于抗病毒药，适用于病毒性肺炎（DE错）。